苯的急性毒作用表现主要为
A. 白细胞减少
B. 中枢神经系统麻醉
C. 再生障碍性贫血
D. 白血病
E. 血小板减少

正确答案：B。中枢神经系统麻醉

解析：本题考查苯的急性中毒表现。急性苯中毒是由于短时间吸入大量苯蒸气引起。主要表现为中枢神经系统症状（B对ACDE错）。轻者出现兴奋、欣快感、步态不稳，以及头晕、头痛、恶心、呕吐等。重者出现剧烈头痛、复视、嗜睡、幻觉、肌肉痉挛、强直性抽搐、昏迷、心律失常、呼吸和循环衰竭。实验室检查可发现尿酚和血苯增高。常有肝、肾损害表现和心电图异常。